“应为艾滋病患者提供社会支持，并给予经济、情感等方面的帮助”属于艾滋病健康教育
A. 治“标”措施
B. “标”“本”兼治措施
C. 治“本”措施
D. 消除社会歧视措施
E. 以上均不正确

正确答案：D。消除社会歧视措施